具有消痞除满健脾和胃作用的方剂是
A. 保和丸
B. 健脾丸
C. 枳实导滞丸
D. 枳实消痞丸
E. 木香槟榔丸

正确答案：D。枳实消痞丸

解析：枳实消痞丸方含干生姜、炙甘草、麦芽曲、白茯苓、白术、半夏曲、人参、厚朴、枳实、黄连，可行气消痞，健脾和胃（D对）。方中枳实苦辛微寒，行气消痞为君；厚朴苦辛而温，行气除满为臣。黄连苦寒清热燥湿而除痞，半夏曲辛温散结而和胃，少佐干姜辛热温中祛寒，三味相伍，辛开苦降，平调寒热，共助枳、朴行气开痞除满之功；麦芽甘平，消食和胃；人参、白术、茯苓、炙甘草（四君子汤）益气健脾，祛湿和中，共为佐药。炙甘草还兼调药之用，亦为使药。保和丸功用为消食化滞，理气和胃（A错）。健脾丸功用为健脾和胃，消食止泻（B错）。枳实导滞丸功用为消导化积，清热利湿（C错）。木香槟榔丸功用为行气导滞，攻积泄热（E错）。